哺乳期不宜使用的药物有
A. 氟喹诺酮类药物
B. 第二代头孢菌素类药物
C. 磺胺类药物
D. 青霉素类药物
E. 氨基糖苷类药物

正确答案：A、C、E。氟喹诺酮类药物；磺胺类药物；氨基糖苷类药物

解析：本题考查哺乳期妇女用药。大多数抗菌药物都能进入乳汁，但进入乳儿体内的药量很小，不会对乳儿产生严重危害。偶有过敏反应、腹泻等情况。青霉素类（D对）对乳儿安全。头孢菌素类（B对）在乳汁中含量甚微，但第四代头孢菌素类如头孢匹罗、头孢吡肟例外。碳青霉烯类如亚胺培南-西司他丁钠等未见对乳儿是否有毒性的报道。大环内酯类100%分泌至乳汁。氨基糖苷类（E错，为本题正确答案）不详，可能具有潜在危害，不宜应用。喹诺酮类（A错，为本题正确答案）对乳儿骨关节有潜在危害，不宜应用。磺胺类（C错，为本题正确答案）在乳汁中的浓度与血浆中一致，在体内与胆红素竞争血浆蛋白，可致游离胆红素增高，尤其在新生儿黄疸时，可促使发生新生儿胆红素脑病（核黄疸）。氯霉素在乳汁中的浓度为血清中的一半，有明显骨髓抑制作用，可引起灰婴综合征，故哺乳期禁用。